在《中国药典》中维生素B₁含量的测定
A. 气相色谱法
B. 碘量法
C. 微生物法
D. 紫外分光光度法
E. 非水溶液滴定法

正确答案：E。非水溶液滴定法

解析：本题考查维生素素B₁的含量测定。中国药典用非水溶液滴定法（E对）测定维生素B₁含量。原理：维生素B₁分子中含有2个碱性的已成盐的伯胺和季铵基团，在非水溶液中均可与高氯酸作用，以电位滴定法指示终点，根据消耗高氯酸的量即可计算维生素B₁的含量。